反映药物安全性的参数是
A. 效能
B. 效价强度
C. 治疗指数
D. 药物量效曲线
E. 曲线的斜率

正确答案：C。治疗指数

解析：治疗指数（TI）是LD₅₀/ED₅₀的比值，药物的安全性指标（C对）。TI越大，药物的安全程度越大。效能是指药物所能产生的最大效应（A错）。效价强度指药物达到一定效应时所需的剂量（B错）。以药物效应强度为纵坐标，药物剂量或浓度为横坐标，得到的曲线即量效曲线，分为量反应量效曲线和质反应量效曲线（D错）。斜率：量-效曲线中段（50%Emax）的曲线坡度（E错）。